妊娠合并急性病毒性肝炎热毒内陷证的治疗方剂为
A. 茵陈蒿汤
B. 胃苓汤
C. 逍遥散
D. 犀角地黄汤合黄连解毒汤
E. 栀子豉汤

正确答案：D。犀角地黄汤合黄连解毒汤

解析：妊娠合并急性病毒性肝炎的热毒内陷证由于孕后饮食不节，感染湿热、邪毒，熏蒸肝胆，胃失和降所致。治宜清热解毒，凉血救阴，方用清热滋阴，凉血散瘀的犀角地黄汤合泻火解毒的黄连解毒汤（D对）加茵陈、大青叶。妊娠合并急性病毒性肝炎湿热蕴结证的治疗方剂为茵陈蒿汤（A错）；湿邪困脾证的治疗方剂为胃苓汤（B错）去桂枝、泽泻，加寄生、菟丝子；妊娠合并急性病毒性肝炎肝郁脾虚证的治疗方剂为逍遥散（C错）《太平惠民和剂局方》加寄生、菟丝子；栀子豉汤（E错）主要功效为清热除烦。